具有抗尿崩症的是
A. 氢氯噻嗪
B. 螺内酯
C. 乙酰唑胺
D. 氨苯蝶啶
E. 阿米洛利

正确答案：A。氢氯噻嗪

解析：氢氯噻嗪（A对）是噻嗪类利尿剂，能明显减少尿崩症患者的尿量及口渴症状，主要因排Na﹢使血浆渗透压降低而减轻口渴感，其抗利尿作用机制不明。螺内酯（B错）（P216）、氨苯蝶啶（D错）（P217）、阿米洛利（E错）（P217）是保钾利尿剂，其作用机制是拮抗醛固酮，主要用于治疗与醛固酮升高有关的顽固性水肿、充血性心力衰竭。乙酰唑胺（C错）（P217）的利尿作用较弱，主要用来治疗青光眼、急性高山病等。